根据1995年《中华口腔医学杂志》组织专家制定的种植成功标准，错误的说法是
A. 功能好
B. 咀嚼效率大于90%
C. 无与种植体相关的感染
D. 对邻牙支持组织无损害
E. 无麻木，疼痛等不适

正确答案：B。咀嚼效率大于90%

解析：1995年中华口腔医学会杂志社在珠海制定的种植成功标准为：①功能好；②无麻木，疼痛等不适；③自我感觉良好；④种植体周围X线无透射区；横行骨吸收不超过1/3，种植体不松动；⑤龈炎可控制；⑥无与种植体相关的感染；⑦对邻牙支持组织无损害；⑧美观；⑨咀嚼效率大于70%；⑩符合上述要求者5年成功率应达到85%以上；10年80%以上。掌握“牙种植手术及效果评估”知识点。